在临床医学研究开始之前，必须要把研究方案提交到哪个部门进行审查
A. 医院党委
B. 科研处
C. 科研评定委员会
D. 伦理委员会
E. 病人所在病房的领导

正确答案：D。伦理委员会

解析：本题考查医学研究的伦理审查。在临床医学研究开始之前，必须要把研究方案提交到伦理委员会进行审查（D对）。涉及人体受试者的生物医学研究的国际伦理学准则明确规定，实验者必须向伦理审查委员会报告的第一类信息是：“在当前知识允许的情况下清楚地说明研究的目标以及进行研究的理由”。